对漏诊后果严重的疾病，要求筛检试验
A. 灵敏度高
B. 灵敏度低
C. 特异度高
D. 特异度低
E. 符合率高

正确答案：A。灵敏度高

解析：本题考查筛检试验的相关内容。对漏诊后果严重的疾病，要求筛检试验灵敏度高（A对BCDE错），这样尽可能多地发现可疑病人。